老年患者。排尿困难3个月。体检发现前列腺变硬，为了排除前列腺癌，最有价值的检查方法是
A. 前列腺特异性抗原（PSA）
B. B超
C. CT
D. MRI
E. 前列腺穿刺活检

正确答案：E。前列腺穿刺活检

解析：直肠指检、血清前列腺特异性抗原（PSA）测定和超声引导下前列腺穿刺活检是诊断前列腺癌的三个主要方法，其中前列腺穿刺活检是确诊前列腺癌的“金标准”，故为了排除前列腺癌，最有价值的检查方法是前列腺穿刺活检（E对）。前列腺特异性抗原（PSA）（A错）具有前列腺组织特异性，血清PSA升高常提示前列腺癌的可能，但前列腺炎、良性前列腺增生等疾病也可引起血清PSA水平升高，故诊断价值不及穿刺活检。B超（B错）、CT（C错）、MRI（D错）均可辅助前列腺癌的诊断，但不能确定肿物性质，因而对排除前列腺癌的帮助不大。